外渗性黏液囊肿常由哪种因素所致
A. 外伤
B. 炎症
C. 过敏
D. 感染
E. 化学刺激

正确答案：A。外伤

解析：本题考查外渗性黏液囊肿。黏液腺囊肿是较为常见的唾液腺瘤样病变，分为外渗性囊肿和滞留性囊肿，其中，外渗性囊肿囊肿占黏液囊肿的80%以上。外渗性囊肿的发生常由外伤（A对）引起的导管破裂、黏液外漏入组织间隙所致。而炎症（B错）、过敏（C错）、感染（D错）等可导致导管堵塞，引发滞留性黏液囊肿。化学刺激（E错）可破坏外周交感神经纤维，导致唾液腺良性肥大等病症。